用作镇痛药的H₁受体拮抗剂是
A. 盐酸纳洛酮
B. 盐酸哌替啶
C. 盐酸曲马多
D. 磷酸可待因
E. 苯噻啶

正确答案：E。苯噻啶